男，29岁，2年前腿部疼痛到医院就诊，被告知怀疑“骨癌”，当时出现不语，行为怪异，摇头晃脑，但逐渐恢复正常，此后骨癌被排除。但患者每遇到不顺心的事，均有类似表现。该患者最有可能的诊断是
A. 分离（转换）障碍
B. 创伤后应激障碍
C. 抑郁障碍
D. 精神分裂症
E. 急性应激障碍

正确答案：A。分离（转换）障碍

解析：青年男性患者，因应激性事件的诱发，当时出现不语，行为怪异，摇头晃脑，但逐渐恢复正常，此后骨癌被排除，综合患者的症状、体征，该患者最可能的诊断是转换－分离障碍（A对）。创伤后应激障碍是由于受到异乎寻常的威胁性、灾难性心理创伤，导致延迟出现和长期持续的精神障碍（B错）。抑郁症以情感低落为主要临床表现，无抑郁障碍“三无、三自”（无助、无望、无用、自罪、自责和自杀）表现（C错）。精神分裂症阳性症状有幻觉、妄想和瓦解症状群，阴性症状表现意志减退、快感缺乏、情感迟钝等（D错）。急性应激障碍的患者在急剧、严重的精神刺激下，立即表现有强烈恐惧体验的精神运动性兴奋（激越，喊叫，行为过多），行为具有一定的盲目性或者为精神运动性抑制，甚至木僵，与本题不符（E错）。